患者，男性，25岁。左面颊、上下眼睑及额头巨大动静脉畸形，可闻及杂音，触及波动感。对于该患者的最佳治疗方案为
A. 手术切除
B. 硬化剂注射
C. 栓塞治疗
D. 栓塞后手术切除
E. 放射治疗

正确答案：D。栓塞后手术切除

解析：本题考查动静脉畸形的治疗。经导管动脉栓塞技术被成功用于动静脉畸形的治疗，并成为主要的治疗手段。软组织的弥漫性动静脉畸形，一般采用无水乙醇栓塞，继而手术切除病变（D对），修整外形，而不能只是单纯的进行栓塞治疗（C错）或者手术切除（A错）。硬化剂注射（B错）主要用于静脉畸形、淋巴管畸形的治疗。目前，没有报道指出放射治疗（E错）在脉管畸形治疗方面的应用。